体内脂肪大量动员时，肝内生成的乙酰辅酶A可生成
A. 葡萄糖
B. CO₂和水
C. 胆固醇
D. 草酰乙酸
E. 酮体

正确答案：E。酮体

解析：正常情况下，乙酰辅酶A与草酰乙酸生成柠檬酸，进入三羧酸循环。体内脂肪大量动员时，因体内草酰乙酸相对不足，肝内生成的大量的乙酰辅酶A主要生成酮体（E对），很少进入三羧酸循环彻底氧化分解为二氧化碳和水（B错）。未控制的糖尿病患者常因葡萄糖利用障碍，脂肪动员生成大量酮体，引起血中酮体升高，导致酮症酸中毒。葡萄糖（A错）不能由乙酰辅酶A生成，因缺乏相应的酶系。胆固醇（C错）原料乙酰CoA主要来自葡萄糖的分解产物。草酰乙酸（D错）在三羧酸循环中不能由乙酰辅酶A合成。